慢性毒性试验的观察指标
A. 以亚慢性毒性试验所提供的毒效应和靶器官为基础
B. 以急性毒性试验所提供的毒效应和靶器官为基础
C. 由研究者自己决定
D. 病理组织学检查可以做也可以不做

正确答案：A。以亚慢性毒性试验所提供的毒效应和靶器官为基础

解析：本题考查慢性毒性试验的观察指标。慢性毒性试验的观察指标是以亚慢性毒性试验所提供的毒效应和靶器官为基础（A对BCD错）。